食管的结构，不正确的是
A. 为肌性管道,全长约25cm，胸段最长,腹段最短
B. 第1狭窄位于咽与食管移行处，距中切牙约15cm
C. 第2狭窄位于食管与左主支气管交叉处，距中切牙25cm，为异物易嵌顿和肿瘤的好发部位
D. 第3狭窄位于穿食管裂孔处，距中切牙约40cm
E. 管壁肌层由平滑肌构成

正确答案：E。管壁肌层由平滑肌构成

解析：食管为肌性管道，长约25cm，胸部最长，腹部最短(A对)，第1狭窄位于食管起始部即咽与食管移行处，距中切牙约15cm(B对)，第2狭窄位于食管与左主支气管交叉处，距中切牙约25cm，且这几个狭窄部位为食管异物易嵌顿和肿瘤的好发部位(C对)，第3狭窄位于食管穿膈的食管裂孔处，距中切牙约40cm(D对)，食管的管壁肌层由横纹肌和平滑肌构成(E错，为本题正确答案)。